男，62岁。1小时前呕血1000ml。既往史：HBsAg（+）20年，冠心病史10年。近期有心绞痛发作。不宜应用的药物是
A. 血管加压素
B. 生长抑素
C. 支链氨基酸
D. 奥美拉唑
E. 法莫替丁

正确答案：A。血管加压素

解析：患者短时间内大量呕血，鉴于HBsAg（乙肝表面抗原）阳性20年，考虑慢性肝炎导致肝硬化，引起胃底食管静脉曲张出血，血管加压素可以收缩血管并减少门静脉血流量从而抑制出血，但是本患者患有冠心病并近期伴有心绞痛，使用血管加压素容易冠状血管收缩，从而导致心绞痛的发生，甚至加重心肌梗死（A对）。生长抑素属于血管活性药物，也可通过减少门静脉血流量来止血，使用后不伴全身血流动力学改变，短期内无不良反应（P453），因此可以使用（B错）。消化道出血易诱发肝性脑病，支链氨基酸对肝性脑病有一定的预防作用，同时对冠状动脉无明显影响，故可以使用（C错）。奥美拉唑属于质子泵抑制剂，法莫替丁属于H2受体拮抗剂，二者均可以抑制胃酸的分泌，升高胃内PH值，避免凝血块消化，使其止血作用得到充分的发挥，亦对冠状动脉无明显影响，所以可以使用（DE错）。